在确立优先项目问题的重要性与可变性评估中，应首先选择哪种情况
A. 非常重要而不可改变
B. 非常重要且可以改变
C. 可以改变，而不重要
D. 不可改变，且不重要
E. 其他情况

正确答案：B。非常重要且可以改变